了解术后颌、（牙合）关系可能出现的变化属于
A. 术后正畸治疗
B. 追踪观察
C. 完成术前准备
D. 确认手术计划
E. 术前正畸治疗

正确答案：B。追踪观察

解析：追踪观察：了解术后颌、（牙合）关系可能出现的变化，进行术后效果评价。移动、矫正后的骨块在愈合过程中，通常会出现轻微的移位，只要不影响临床效果，则保持术后的正畸巩固治疗即可；但如出现明显的复发倾向时，即需要进行相应的处理。根据骨切开后的愈合过程及其生物力学特点，术后的追踪观察至少应持续6个月。掌握“牙颌面畸形”知识点。